男，10岁。反复浮肿半年。尿常规：蛋白+++-++++，红细胞8-18/HP，血尿素氮10.8mmol/L（30mg/dl），血清总蛋白40g/L（4g/dl），白蛋白15g/L，（1.52/dl），BP150/100mmHg，诊断考虑为
A. 急性链球菌感染后肾炎
B. 单纯性肾病
C. 病毒性肾炎
D. 急进性肾炎
E. 肾炎性肾病

正确答案：E。肾炎性肾病

解析：男孩，有尿蛋白+++-++++、白蛋白15g/L的临床表现，可判断为肾病综合征。肾病综合征可以分为两类单纯性肾病和肾炎性肾病，由于该患儿还有血尿、高血压的症状，应诊断为肾炎性肾病（E对），而不是单纯性肾病（单纯性肾病没有血尿、高血压等表现）（B错）。虽然急性链球菌感染后肾炎也会有血尿、蛋白尿、水肿、高血压的表现，但急性链球菌感染后肾炎的蛋白尿量不会超过+++，因此该患儿不是急性链球菌感染后肾炎（A错）。肾炎多由细菌感染引起，病毒性肾炎很罕见（C错）。急进性肾炎很少见于儿童，一般表现为短时间内肾功能急剧下降，因此急进性肾炎不符合题意（D错）。